男性，30岁，1年前下岗。近5个月来觉得邻居都在议论他，常不怀好意地盯着他，有时对着窗外大骂，自语自笑，整天闭门不出，拨110电话要求保护。该病人不存在
A. 幻听
B. 关系妄想
C. 被害妄想
D. 情绪低落
E. 行为退缩

正确答案：D。情绪低落

解析：该中年男性患者，近5个月来觉得邻居都在议论他（幻听）（A对），常不怀好意地盯着他（关系妄想和被害妄想）（BC对），闭门不出，是妄想、幻觉的支配下所表现的行为退缩（E对），故诊断为精神分裂症偏执型。患者没有情感低落（忧愁、苦闷、唉声叹气、暗自落泪）的表现，情感低落多见于抑郁发作（D错，为本题正确答案）。